翳风穴位于
A. 胸锁乳突肌后缘，平下颌角处
B. 乳突前下方与下颌角之间的凹陷中
C. 乳突后下方凹陷中
D. 胸锁乳突肌与斜方肌上端之间的凹 陷中
E. 后发际正中直上0.5寸，旁开1.3寸， 当斜方肌外缘凹陷中

正确答案：B。乳突前下方与下颌角之间的凹陷中

解析：胸锁乳突肌后缘，平下颌角处为天牗穴（A错）。乳突前下方与下颌角之间的凹陷中为翳风穴（B对）。乳突后下方凹陷中为完骨穴（C错）。胸锁乳突肌与斜方肌上端之间的凹陷中为风池穴（D错）。后发际正中直上0.5寸，旁开1.3寸，当斜方肌外缘凹陷中为天柱穴（E错）。